性早熟的定义是
A. 女童在8岁以前出现乳房增大
B. 女童在8岁以前出现阴毛、腋毛生长
C. 女童在10岁以前月经来潮
D. 女童在8岁以前出现第二性征发育
E. 以上一种或一种以上者，均属性早熟

正确答案：E。以上一种或一种以上者，均属性早熟

解析：本题考查性早熟的相关内容。性早熟是指第二性征出现的年龄比预计青春期发育年龄早2.5个标准差，女童在8岁以前出现任何一种或一种以上第二性征的发育（E对ABCD错），包括以下发育特点：女童在8岁以前出现第二性征发育，即乳房增大、阴毛、腋毛生长；女童在10岁以前月经来潮。